男性，54岁。1年前日常活动后出现胸骨后疼痛，每日2～3次，近2月发作次数增多，每日5～6次，轻微活动也能诱发，发作时心电图ST段呈一过性水平压低，应诊断为
A. 稳定性心绞痛
B. 不稳定性心绞痛
C. 心内膜下心肌梗死
D. 中间综合症
E. 变异型心绞痛

正确答案：B。不稳定性心绞痛

解析：患者中老年男性，1年前活动后出现胸骨后疼痛，每日2～3次，提示为稳定型心绞痛，近2月发作频繁，次数加多，诱导心绞痛的活动阈值下降，考虑为稳定型心绞痛发展为不稳定型心绞痛（B对A错）。心内膜下心肌梗死（八版内科学P243）（C错）指缺血坏死仅累及心室壁的内层。发作多无明显诱因，常烦躁不安、大汗淋漓或有濒死感，多伴有血压下降，心动过速等。中间综合症（急性冠状动脉功能不全）（D错）系指24h内心绞痛反复发作，历时较长，达30min到1h或以上，发作常在休息时或睡眠中，且无明显诱因，与本例不符。变异型心绞痛（P245）（E错）又称血管痉挛性心绞痛，多于静息时发作，无体力活动等诱因，多伴有一过性ST段抬高。